药物质检有配伍禁忌的处方属于
A. 不规范处方
B. 不适宜处方
C. 超常处方
D. 普通处方
E. 麻醉药品处方

正确答案：B。不适宜处方

解析：本题考查不适宜处方。药物质检有配伍禁忌的处方属于不适宜处方（B对）。有下列情况之一的，应当判定为不规范处方（A错）：（1）处方的前记、正文、后记内容缺项，书写不规范或者字迹难以辨认的；（2）医师签名、签章不规范或者与签名、签章的留样不一致的；（3）药师未对处方进行适宜性审核的（处方后记的审核、调配、核对、发药栏目无审核调配药师及核对发药药师签名，或者单人值班调剂未执行双签名规定）；（4）早产儿、新生儿、婴幼儿处方未写明体重或日、月龄的；（5）未使用药品规范名称开具处方的；（6）化学药、中成药与中药饮片未分别开具处方的；（7）药品的剂量、规格、数量、单位等书写不规范或不清楚的；（8）用法、用量使用“遵医嘱”、“自用”等含糊不清字句的；（9）处方修改未签名并注明修改日期，或药品超剂量使用未注明原因和再次签名的；（10）开具处方未写临床诊断或临床诊断书写不全的；（11）单张门急诊处方超过5种药品的；（12）无特殊情况下，门诊处方超过7日用量，急诊处方超过3日用量，慢性病、老年病或特殊情况下需要适当延长处方用量未注明理由的；（13）开具麻醉药品、精神药品、医疗用毒性药品、放射性药品等特殊管理药品处方未执行国家有关规定的（包括处方颜色、用量、证明文件等）；（14）医师未按照抗菌药物临床应用管理规定开具抗菌药物处方的；（15）中药饮片处方药物未按照“君、臣、佐、使”的顺序排列，或未按要求标注药物调剂、煎煮等特殊要求的。有下列情况之一的，应当判定为超常处方（C错）：（1）无适应证用药；（2）无正当理由开具高价药的；（3）无正当理由超说明书用药的；（4）无正当理由为同一患者同时开具2种以上药理作用相同药物的。普通处方（D错）区分于特殊病种专用处方，处方的印刷用纸为白色。麻醉药品处方（E错）是开具麻醉药的处方。